不属于感染性疾病的有
A. 寻常狼疮
B. 雪口疮
C. 带状疱疹
D. 寻常型天疱疮
E. 手-足-口病

正确答案：D。寻常型天疱疮

解析：本题考查口腔黏膜感染性疾病。天疱疮为自身免疫性疾病，非感染性疾病，根据皮肤损害特点可分为寻常型、增殖型、落叶型和红斑型，寻常型发生于口腔黏膜损害最为多见（D错，为本题的正确答案）。寻常狼疮是由结核杆菌所引起的慢性进行性皮肤感染，寻常狼疮是一种毛囊、皮脂腺的慢性炎症，属感染性疾病（A对）。雪口疮为念珠菌感染引起的，属感染性疾病（B对）。手-足-口病是柯萨奇A16病毒感染，为病毒感染性疾病（E对）。